孕妇生产，腹痛6小时，宫口开大4cm，宫缩40s/6-7min，胎膜未破，胎儿骶左前，S+1，宫口可触及胎足，接下来的处理是
A. 剖宫产
B. 静滴缩宫素
C. 观察待自然分娩
D. 破膜
E. 臀位助产

正确答案：A。剖宫产

解析：腹痛6小时，宫口开大4cm，宫缩40s/6-7min，胎膜未破，胎儿骶左前，S+1，宫口可触及胎足，产妇符合剖宫产手术指征，故恰当的处理措施是尽快剖宫产（A对）。人工破膜（D错）、静滴缩宫素（B错）、臀位助产（E错）适用于宫缩乏力，为促进产程进展而采取的方法。观察自然分娩（C错）不适用于足先露。